有关左心房的说法，错误的是
A. 肺静脉口和冠状窦口是左心房的流入口
B. 左房室口是左心房的流出口
C. 左、右心房互相不通
D. 左心房内流动着动脉血
E. 左心房是心脏中最靠后的部分

正确答案：A。肺静脉口和冠状窦口是左心房的流入口

解析：冠状窦口（A错，为本题正确答案）位于右心房。左房室口是左心房的流出口（B对）。左、右心房互相不通（C对）。左心房内流动着动脉血（D对）。左心房是心脏中最靠后的部分（E对）。